有关鼻泪管的叙述不正确的是
A. 是鼻腔和泪腺连通的膜性管道
B. 向上通泪囊，向下通下鼻道
C. 上部包藏于骨性鼻泪管中，与骨膜紧密相连
D. 开口于上鼻道外侧壁粘膜内
E. 属于泪道的一部分

正确答案：D。开口于上鼻道外侧壁粘膜内

解析：鼻泪管是鼻腔和泪腺连通的膜性管道（A对），上部包藏于骨性鼻泪管中，与骨膜紧密相连（C对），向上通泪囊，向下通下鼻道（B对），开口于下鼻道外侧壁黏膜内，而非开口于上鼻道外侧壁黏膜内（D错，为本题正确答案），和泪点、泪小管、泪囊构成泪道，即鼻泪管属于泪道的一部分（E对）。